关于真核细胞DNA聚合酶α活性的叙述，下列哪项正确
A. 合成前导链
B. 具有核酸酶活性
C. 具有引物酶活性，它能合成10个核苷酸左右的RNA
D. 底物是NTP
E. 是线粒体内DNA复制的主要酶

正确答案：C。具有引物酶活性，它能合成10个核苷酸左右的RNA